病例组的暴露比值与对照组的暴露比值之比
A. 率比（RR）
B. 优势比（OR）
C. 人时发病率
D. 归因危险度
E. 病因分值

正确答案：B。优势比（OR）

解析：本题考查优势比的概念。优势比（OR）（B对ACDE错），又称比值比、比数比，为病例组与对照组两组暴露比值之比。